区别挥发油与油脂常用的方法是
A. 相对密度
B. 溶解性
C. 皂化值
D. 油迹实验
E. 比旋度

正确答案：D。油迹实验

解析：本题考查的是挥发油的挥发性。区别挥发油与油脂常用的方法是油迹实验（D对）。挥发油的通性：1.性状：常温下挥发油大多为无色或淡黄色的透明液体，少数挥发油具有其他颜色，如薁类多显蓝色，佛手油显绿色，桂皮油显红棕色。多具浓烈的特异性气味，其气味常是其品质优劣的重要标志。冷却条件下挥发油主要成分常可析出结晶，称“析脑”，这种析出物习称为“脑”，如薄荷脑、樟脑等。滤去析出物的油称为“脱脑油”，如薄荷油的脱脑油习称“薄荷素油”，但仍含有约50%的薄荷脑。2.挥发性：挥发油在常温下可自然挥发，如将挥发油涂在纸片上，较长时间放置后，挥发油因挥发而不留油迹，脂肪油则留下永久性油迹，据此可区别二者。挥发油可随水蒸气蒸熘。3.溶解性（B错）：挥发油不溶于水，易溶于石油醚、乙醚、二硫化碳、油脂等亲脂性有机溶剂，在高浓度的乙醇中能溶解。4.物理常数：挥发油多数比水轻，也有的比水重（如丁香油、桂皮油），相对密度（A错）一般在0.85～1.065之间。挥发油几乎均有光学活性，比旋度（E错）在+97°～+117°范围内。多具有强的折光性，折光率在1.43～1.61之间。挥发油的沸点一般在70℃～300℃之间。5.稳定性：挥发油与空气及光线经常接触会逐渐氧化变质，使挥发油的相对密度增加，颜色变深，失去原有香味，形成树脂样物质，不能随水蒸气蒸馏。因此，制备挥发油方法的选择要合适，产品也要装入棕色瓶内密塞并低温保存。6.化学反应：挥发油组成成分常含有双键、醇羟基、醛、酮、酸性基团、内酯等结构，故能发生相应的化学反应，如与溴及亚硫酸氢钠发生加成反应、与肼类产生缩合反应，并有银镜反应、异羟肟酸铁反应、皂化反应及遇碱成盐反应等。挥发油的皂化值（C错）：是代表挥发油中游离羧酸、酚类成分和结合态酯总量的指标。以皂化1g挥发油所消耗氢氧化钾的毫克数表示。皂化值是酸值和酯值之和。